口腔颌面部肿瘤诊断方法中，较为准确可靠的方法是
A. 局部临床检查
B. X线检查
C. 超声波检查
D. 活体组织检查
E. 穿刺检查

正确答案：D。活体组织检查

解析：本题考查口腔颌面部肿瘤的诊断。口腔颌面部肿瘤诊断方法中，较为准确可靠的方法是活体组织检查（D对）。活体组织检查是从病变处切取一小块组织制成切片，在显微镜下观察细胞形态和结构，以确定病变性质、肿瘤类型和分化程度的方法，是目前比较准确可靠的，也是结论性诊断方法。局部临床检查（A错）是指医生进行望诊、触诊、听诊等获取病变的信息，对诊断有一定帮助，但不同肿瘤会有类似的临床表现，所以单纯临床检查并不可靠。X线检查（B错）主要用以了解骨组织肿瘤的性质及其侵及范围；超声波检查（C错）用于检查囊性肿瘤和软组织肿瘤，可提示有无肿块存在及其大小和良恶性程度；但不同肿瘤会有类似的影像学表现，所以X线和超声波检查主要是协助诊断，有重要的参考价值。穿刺检查（E错）是针对触诊有波动感，或非实质性含有液体的肿瘤的检查，其他实性等肿瘤不适用，有时对肿瘤的组织学类型难以确定，也是协助诊断的手段。